对病毒性感染进行血清学诊断时，双份血清抗体效价至少增高几倍时，才有诊断意义
A. 2倍
B. 4倍
C. 8倍
D. 16倍
E. 32倍

正确答案：B。4倍